男，22岁。大量饮酒后突发上腹部胀痛，伴恶心、呕吐2小时。查体：P102次／分，BP110/60mmHg，双肺呼吸音清，未闻及干湿性啰音，心律齐。上腹部压痛明显，上腹痛（＋），肠鸣音减弱。血、尿常规及尿淀粉酶检查，立位腹部X线平片均未见明显异常。最可能的诊断是
A. 急性肠梗阻
B. 胆囊结石
C. 急性胰腺炎
D. 急性胆囊炎
E. 上消化道穿孔

正确答案：C。急性胰腺炎

解析：青年男性，大量饮酒（急性胰腺炎常见诱因）后突发上腹部胀痛、伴恶心、呕吐（急性胰腺炎常表现为腹痛、腹胀、恶心、呕吐及腹膜炎体征）2小时。查体：P102次／分（正常值60～100次/分），BP110/60mmHg（正常值90～140/60～90mmHg，提示低血容量性休克），上腹部压痛明显、上腹痛（＋）、肠鸣音减弱（腹膜炎体征），最可能诊断为急性胰腺炎（C对）。急性肠梗阻（A错）（P481）表现为腹痛、腹胀、呕吐和肛门排气排便停止四大典型症状。胆囊结石（B错）（P481）表现为午夜腹痛。急性胆囊炎（D错）（P481）表现为进食油腻食物后发作右上腹绞痛，向右肩和右腰部放射，体检时右上腹有压痛、反跳痛、肌紧张、Murphy征阳性。上消化道穿孔（E错）（P481）表现为突发上腹部刀割样疼痛，明显腹膜刺激征，典型“板状腹”。